劳动强度过大，工作组织和制度不合理，劳动姿势不良，劳动工具不合适，精神方面或个别器官系统过度紧张，这样一些有害因素可统称为
A. 物理性职业有害因素
B. 生物性职业有害因素
C. 生产过程中的有害因素
D. 劳动过程中的有害因素
E. 生产环境中的有害因素

正确答案：D。劳动过程中的有害因素